某男，64岁。因多饮，多食，多尿，体重减轻3年余就诊。3年来患者无明显诱因出现烦渴引饮，消谷善饥，小便频数而量多，尿液浑浊而黄，大便干燥密结，舌红，苔薄黄，脉滑数。平素嗜食肥甘厚味，长期饮酒，每日饮白酒250g，运动量少。体重从100kg下降至80kg。查空腹血糖9.0mmol/L，西医诊断为糖尿病，中医诊所为消渴病，辨证为阴虚燥热证，处方如下：中药汤剂：玉女煎加味：煅石膏30g，熟地黄20g，麦冬15g，知母10g，怀牛膝10g，天花粉15g，共5剂，水煎服，每日1剂，早、晚分服。西药：盐酸二甲双胍片500mg×20片，每次500mg，3次/日。中成药：清胃黄连丸9g×10丸，1丸/次，2次/日。执业药师对该患者进行用药指导时，用药建议错误的是
A. 中药汤剂与西药隔开30分钟以上服用
B. 应戒酒，以免影响盐酸二甲双胍的疗效
C. 清胃黄连丸为蜜丸，宜改用清胃黄连片
D. 盐酸二甲双胍片与清胃黄连丸同时服用
E. 清胃黄连丸苦寒伤胃，不可过量或久服

正确答案：D。盐酸二甲双胍片与清胃黄连丸同时服用

解析：本题考查的是老年人合理应用中药的原则。执业药师对该患者进行用药指导时，用药建议错误的是盐酸二甲双胍片与清胃黄连丸同时服用（D错，为本题正确答案）。由于老年人的靶器官或细胞的敏感性增强，使他们对药物的反应比年轻人强烈，特别是对中枢神经抑制药物、降血糖药物、心血管系统药物反应特别敏感，在正常剂量下的不良反应增加，甚至出现药源性疾病，因此在联合用药中应高度重视。如患有糖尿病的心脑血管患者用培元通脑胶囊、益心通脉颗粒、活血通脉片等含有甘草、人参、鹿茸等成分的中成药，可使降糖药的疗效降低。因为，甘草、人参、鹿茸具有糖皮质激素样作用，可以促进糖原异生，升高血糖，与降糖药二甲双胍、消渴丸、阿卡波糖和胰岛素产生拮抗作用，导致降糖效果降低。因此，要尽量准确了解老年患者的用药情况，对此类患者尽量选用不含此类成分的中成药。清胃黄连丸（黄连、石膏、黄芩、栀子、连翘、知母、黄柏、玄参、地黄、牡丹皮、赤芍、天花粉、桔梗、甘草）中含有甘草，故不能与盐酸二甲双胍同时服用。中成药和西药联用时，应相隔半小时左右服用（A对）。酒或中药酒剂、酊剂中均含有一定浓度的乙醇。乙醇是常见的酶促剂，在与二甲双胍合用时，会发生酶促反应，使二甲双胍在体内代谢加速，半衰期缩短，药效下降。故在服用二甲双胍时应戒酒（C对）。盐酸二甲双胍片为降糖药，清胃黄连丸为大蜜丸，含有大量蜂蜜。蜂蜜、饴糖等含糖量较多的中药及其制剂，不可与胰岛素、格列本脲等治疗糖尿病的西药同用，以免影响疗效。故应改用清胃黄连片（D对）。清胃黄连丸苦寒伤胃，不可过量或久服（E对）。